属于趋化因子CXC亚族的代表成员是
A. IL-2
B. IL-4
C. IL-6
D. IL-8
E. IL-12

正确答案：D。IL-8